流行病学实验研究中的盲法是指
A. 试验的设计者、研究者和研究对象不知道分组
B. 试验的设计者、研究者和研究对象不知道试验设计
C. 试验的设计者、研究者和研究对象不知道研究结局
D. 试验的设计者、研究者和研究对象不知道研究目的
E. 试验的设计者、研究者和研究对象不知道如何评价效果

正确答案：A。试验的设计者、研究者和研究对象不知道分组